某男，51岁。素有高血压，症见头昏胀痛，两侧为重，耳鸣目眩，心烦易怒，夜寐不宁，口苦面红；舌红苔黄，脉弦数。四诊合参，辨析其证候是
A. 风寒头痛
B. 风热头痛
C. 肝阳头痛
D. 血虚头痛
E. 瘀血头痛

正确答案：C。肝阳头痛

解析：本题考查头痛之肝阳头痛的症状。中医四诊合参，辨证为肝阳头痛（C对）。头痛之肝阳头痛【症状】头昏胀痛，两侧为重，心烦易怒，夜寐不宁，口苦面红，或兼胁痛。舌红苔黄，脉弦数。【治法】平肝潜阳息风。头痛之风寒头痛（A错）【症状】头痛时作，痛连项背，常有拘急收紧感，伴恶风畏寒，受风尤剧，口不渴。舌苔薄白，脉浮紧。【治法】疏风散寒止痛。头痛之风热头痛（B错）【症状】头痛而胀，甚则头痛如裂，发热或恶风，口渴欲饮，面红目赤，或便秘溲黄。舌尖红，苔黄，脉浮数。【治法】疏风清热和络。头痛之血虚头痛（D错）【症状】头痛隐隐，时时昏晕，心悸失眠，面色少华，神疲乏力，遇劳加重。舌质淡，苔薄白，脉细弱。【治法】养血滋阴，和络止痛。头痛之瘀血头痛（E错）【症状】头痛经久不愈，痛处固定不移，痛如锥刺，或有头部外伤史。舌紫暗，或有瘀斑，瘀点，苔薄白，脉细或细涩。【治法】活血化瘀，通窍止痛。